起效快，可迅速缓解急性哮喘发作和支气管平滑肌痉挛的药品是
A. 布地奈德
B. 扎鲁司特
C. 沙丁胺醇
D. 羧甲司坦
E. 多索茶碱

正确答案：C。沙丁胺醇

解析：本题考查沙丁胺醇。起效快，可迅速缓解急性哮喘发作和支气管平滑肌痉挛的药品是沙丁胺醇（C对）。沙丁胺醇口服给药后30min内起效，吸入可快速起效（3～5min），具有速效、短效、高选择性特点，气雾剂主要用于缓解哮喘或慢性阻塞性肺疾病（COPD）患者的支气管痉挛，预防运动诱发的急性哮喘，或其他过敏原诱发的支气管痉挛。布地奈德（A错）为吸入型糖皮质激素，适用于轻度持续型（2级以上）哮喘的长期治疗，吸入剂用于哮喘和COPD的预防和长期维持治疗。扎鲁司特（B错）为白三烯受体拮抗剂，起效慢，一般连续应用4周显效。作用较弱，相当于色甘酸钠。仅适用于轻、中度哮喘和稳定期的控制，或合并应用以减少肾上腺皮质激素和β₂受体激动剂的剂量。羧甲司坦（D错）为祛痰药。多索茶碱（E错）为黄嘌呤类药物，具有松弛气道平滑肌、呼吸兴奋、强心等作用，适用于慢性喘息的治疗和预防，辅助治疗急性哮喘、急性心功能不全和心源性哮喘，但急性心肌梗死伴血压显著降低患者禁用。